药用部位为根的是
A. 白芷
B. 川芎
C. 两者都是
D. 两者都不是

正确答案：A。白芷

解析：本题考查的是白芷的来源。药用部位为根的是白芷（A对）。白芷：【来源】伞形科植物白芷或杭白芷的干燥根。川芎（B错）：【来源】伞形科植物川芎的干燥根茎。